女性，68岁。双膝关节疼痛、活动弹响10余年，无关节肿，爬山后加重，膝关节有骨擦音，X线片示膝关节间隙窄，髁间嵴增生，骨赘形成，最可能的诊断是
A. 类风湿性关节炎
B. 骨关节炎
C. 骨质疏松症
D. 强直性脊柱炎
E. 痛风

正确答案：B。骨关节炎

解析：老年女性患者（骨关节炎好发人群），双膝关节疼痛，活动弹响10余年，膝关节有骨擦音（骨关节炎常见表现），X线片示膝关节间隙狭窄，踝间嵴增大，骨赘形成（骨关节炎典型影像学表现），本例最可能的诊断为骨性关节炎（B对）。类风湿性关节炎（A错）有关节外风湿结节表现。骨质疏松症（C错）常见表现为腰背疼痛、乏力或全身骨痛，骨痛通常为弥漫性、无固定部位（P787）。强直性脊柱炎（D错）多见于青年男性，最典型和常见症状为炎性腰背痛（P825）。痛风（E错）关节炎发作以单侧第1跖趾关节最常见，发作常呈自限性，多于数天或2周内自行缓解（P861）。